钩藤一般宜生用，不加热炮制的主要原因是
A. 所含黄酮易被水解
B. 所含生物碱易被破坏
C. 所含挥发油易被氧化
D. 所含鞣质易被氧化
E. 所含有机酸易被破坏

正确答案：B。所含生物碱易被破坏

解析：本题考查炮制对含生物碱类药物成分的影响。如钩藤所含有效成分为钩藤碱、异钩藤碱等，加热易被破坏，故一般宜生用，入汤剂亦不可久煎，宜后下。石斛、山豆根、防己、石榴皮、龙胆草等药物古代本草中就注“勿近火”，现代研究表明这些药物中所含生物碱（B对）受热后含量降低，影响药效。游离状态的挥发油（C错）在自然状态下易于挥发损失，所以对含游离挥发油的薄荷、荆芥等宜在采收后或喷润后迅速加工切制，不宜带水堆积久放，以免挥发油损失，影响质量。有些药材所含挥发油是以结合状态存在于植物体内，则宜经堆积发酵后香气方可逸出，如厚朴必须经过埋藏发酵后，才能加工炮制出优质饮片。鞣质因结构中含有多元酚羟基，具强还原性，如暴露于日光和空气中则易被氧化，致颜色加深。如槟榔、白芍等切片时长时间露置空气中表面色泽会泛红，是因所含的鞣质被氧化（D错）所致。有机酸含量较高时对口腔、胃黏膜刺激性较大，加热炮制可降低含量，减缓毒副作用。如山楂采用炒黄、炒焦法炮制后，部分有机酸被破坏（E错），酸性降低，减少了对胃肠道的刺激。